既能涩肠止泻，又能温肾散寒的中成药是
A. 参苓白术散
B. 萆薢分清丸
C. 金锁固精丸
D. 固本益肠片
E. 四神丸

正确答案：E。四神丸

解析：本题考查四神丸的功能。既能涩肠止泻，又能温肾散寒的中成药是四神丸（E对）。四神丸（片）【功能】温肾散寒，涩肠止泻。参苓白术散（A错）（水丸、颗粒）【功能】补脾胃，益肺气。萆薢分清丸（B错）【功能】分清化浊，温肾利湿。金锁固精丸（C错）【功能】固肾涩精。固本益肠片（D错）【功能】健脾温肾，涩肠止泻。